子宫脱垂是指
A. 子宫口低于耻骨联合上缘
B. 子宫口低于耻骨联合下缘
C. 子宫口低于坐骨棘平面
D. 子宫口低于坐骨结节平面
E. 子宫口低于尾骨尖

正确答案：C。子宫口低于坐骨棘平面

解析：子宫口低于坐骨棘平面（C对）称为子宫脱垂，脱垂严重者子宫颈可脱出阴道。